以上哪种疾病的特点为棘层松解和上皮内疱形成
A. Garré骨髓炎
B. 放射性骨髓炎
C. 牙周炎静止期
D. 慢性化脓性骨髓炎
E. 天疱疮

正确答案：E。天疱疮

解析：天疱疮的病例特点为棘层松解和上皮内疱形成。掌握“急慢性化脓性颌骨骨髓炎”知识点。